有关健康的正确提法是
A. 健康是指体格健全没有疾病
B. 不生病就是健康
C. 健康是指社会适应能力的完全良好状态
D. 健康是指精神上的完全良好状态
E. 健康不仅是指没有疾病或病痛，而且是躯体上、精神上和社会上的完全良好状态

正确答案：E。健康不仅是指没有疾病或病痛，而且是躯体上、精神上和社会上的完全良好状态

解析：健康不仅是没有疾病或衰弱现象,而是躯体上、精神上和社会适应上的一种完好状态（E对）。